环境噪声常影响
A. 听觉系统
B. 心血管系统
C. 急慢性疾病和某些癌变
D. 免疫力
E. 血液循环

正确答案：A。听觉系统

解析：本题考查环境噪声对机体的影响。环境噪声是指在工业生产、建筑施工、交通运输和社会生活中所产生的干扰周围生活环境的声音。环境噪声可影响人们的听觉系统（A对BCDE错），按其影响程度可分为听觉适应、听觉疲劳和听力损伤三个等级。